现有60例心脏移植患者，随访观察其术后5年存活情况，其中2例由于迁居国外而失访，36例在随访结束时存活，而20例在随访期中由于心脏原因发生死亡，2例由于意外事故发生死亡。上述实例中，起始事件是
A. 心脏病患病
B. 心脏移植手术
C. 心脏移植手术并发症
D. 心脏病死亡
E. 心脏病复发

正确答案：B。心脏移植手术

解析：本题考查起始事件。本题研究的是心脏移植患者随访观察术后5年的存活情况，因此其起始事件为心脏移植手术（B对ACDE错）。